淡水藻类毒素或蓝藻毒素可分为
A. 麻痹性毒素、腹泻性毒素、皮肤毒素
B. 麻痹性毒素、腹泻性毒素、神经毒素
C. 肝毒素、神经毒素、皮肤毒素
D. 肝毒素、神经毒素、腹泻性毒素
E. 肝毒素、麻痹性毒素、腹泻性毒素

正确答案：C。肝毒素、神经毒素、皮肤毒素

解析：本题考查淡水藻类毒素或蓝藻毒素的分类。淡水藻类毒素或蓝藻毒素可分为肝毒素、神经毒素和皮肤毒素（C对ABDE错）。肝毒素又可分为环肽毒素和生物碱毒素。